领先时间偏倚是指下列何项引起的偏倚
A. 筛选发现病例的诊断时间与病例死亡时间之差
B. 筛选发现病例的诊断时间与患病时间之差
C. 筛选发现病例的诊断时间与住院时间之差
D. 筛选发现病例的诊断时间与出现症状后得到诊断的时间之差
E. 发病至住院确诊的时间之差

正确答案：D。筛选发现病例的诊断时间与出现症状后得到诊断的时间之差

解析：本题考查领先时间偏倚。领先时间是指临床前筛查诊断的时点（年龄）至常规临床诊断时点（年龄）之间的时间间隔（D对ABCE错）。如果筛查只提前了发现疾病的时点，而并未改变筛查人群的死亡时点（年龄），也会观察到筛查人群比不筛查人群生存时间更长的假象，即领先时间偏倚。